患者胸闷刺痛，痛有定处，有时痛引肩背，恶心呕吐，口中粘腻，头晕目眩，心悸气短，面部暗青，舌紫暗苔白腻，脉弦滑。其治法是
A. 豁痰化瘀
B. 祛瘀止痛
C. 豁痰理气
D. 通阳泄浊
E. 益气养阴

正确答案：A。豁痰化瘀

解析：瘀血阻于心胸，故见心胸疼痛，如刺如绞；血液淤积不散，故见痛有定处；夜间阳气内藏，阴气用事，血行较缓，瘀阻更甚，故见疼痛入夜尤甚；手少阴心经之脉横出腋下，循肩背、内臂后缘，故见心痛彻背，背痛彻心，痛引肩背；血行瘀滞，故见舌质紫暗，有瘀斑，苔薄，脉弦涩，或结代。故诊断为胸痹心痛的心血瘀阻证，代表方：血府逐瘀汤。痰浊闭阻证：恶心呕吐，口中粘腻，头晕目眩，心悸气短，代表方：瓜蒌薤白半夏汤合涤痰汤。患者胸痹心痛，痰瘀并见，宜豁痰化瘀（A对）。祛瘀止痛没有体现豁痰宣痹的治法（B错）。豁痰理气没有体现活血化瘀的治法（C错）。通阳泄浊治疗胸痹心痛的寒凝心脉证（D错）。益气养阴治疗胸痹心痛的气阴两虚证（E错）。